下列关于假药的情形叙述正确的是
A. 变质的药品
B. 被污染的药品
C. 国务院药品监督管理部门规定禁止使用的药品
D. 所标明的适应证或者功能主治超出规定范围的药品
E. 以上均是

正确答案：E。以上均是

解析：有下列情形之一的药品，按假药论处：1)国务院药品监督管理部门规定禁止使用的；2)依照本法必须批准而未经批准生产、进口，或者依照本法必须检验而未经检验即销售的；3)变质的；4)被污染的；5)使用依照本法必须取得批准文号而未取得批准文号的原料药生产的；6)所标明的适应证或者功能主治超出规定范围的。掌握“药品管理及法律责任”知识点。